男，3岁。腹泻4天，加重2天，稀水样便每日十余次，尿量减少。体检：眼窝凹陷，皮肤弹性差，脉搏可扪及。查血钠135mmol/L。其腹泻脱水的程度与性质应是
A. 轻度低渗牲
B. 轻度等渗性
C. 中度高渗性
D. 中度等渗性
E. 重度低渗性

正确答案：D。中度等渗性

解析：患儿呈现“眼窝凹陷、皮肤弹性差”的脱水貌，轻度脱水时皮肤弹性尚可（AB错），重度脱水时可出现精神萎靡及休克症状，表现为皮肤湿冷花斑，弹性极差、脉搏细速、低血压、少尿甚至无尿，题中并无类似严重表现（E错），可诊断为中度脱水。血钠正常范围是130-150mmol/L，患儿血钠不低，为等渗性脱水（D对）。